某女，49岁，经血非时而下，出血量多，淋沥不尽，色淡质稀，两目干涩，腰膝酸软，面色晦暗，舌淡暗，脉沉弱。根据辩证结果，应选用的治法是
A. 补益肝肾，固冲止血
B. 益气补血，化瘀止血
C. 健脾益气，固冲止血
D. 活血化瘀，温经止血
E. 滋肾降火，育阴止血

正确答案：A。补益肝肾，固冲止血

解析：本题考查的是崩漏的辨证论治。经血非时而下，出血量多，淋沥不尽，色淡质稀，两目干涩，腰膝酸软，面色晦暗，舌淡暗，脉沉弱。根据辩证结果，应选用的治法是补益肝肾，固冲止血（A对）。崩漏是月经的周期、经期、经量发生严重失常的病证，经血非时暴下不止或不尽，前者谓之崩中，后者谓之漏下。崩与漏出血情况虽不同，然二者常相互转化，交替出现，且其病因病机基本相同，故概称崩漏。西医学中的无排卵性功能性子宫出血，可参照本证进行辨证治疗。（一）气血两虚证：【症状】出血量多或淋沥不尽，血色淡薄，面色无华，气短懒言，食欲不振，便溏。舌质淡，苔薄白湿润，脉细弱。【治法】补脾摄血，引血归经（B错）。（二）脾不统血证：【症状】出血量多，日久而止，气短神疲，面色㿠白，或面浮肢肿，手足不温，或饮食不佳，大便溏。舌质淡，苔薄白，脉弱或沉弱。【治法】健脾补气，养血调经（C错）。（三）肝肾不足证：【症状】月经非时而下，或月经先期，经期延长，经血暗红，量少而淋沥不畅，咽干颧红，心烦潮热，腰膝酸软。舌红苔少或光剥苔，脉沉细无力。【治法】滋补肝肾，止血调经。（四）瘀血阻络证：【症状】经血非时而下，量时多时少，时出时止，或淋沥不断，或停闭数月又突然崩中，继之漏下，经色暗有血块；舌质紫暗或尖边有瘀点，脉弦细或涩。【治法】活血化瘀，固冲止血（D错）。绝经前后诸证阴虚火旺证【症状】绝经前后，月经紊乱，心烦易怒，懊恼不安，坐卧不宁，哭笑无常，夜卧多梦善惊，口干渴饮，尿黄便燥。舌质红，苔薄黄，脉弦细而数。【治法】滋阴降火宁神（E错）。